调配饮片时，每剂中药的重量误差应控制在
A. ±1%以内
B. ±2%以内
C. ±3%以内
D. ±5%以内
E. ±10%以内

正确答案：D。±5%以内

解析：本题考查的是药味调配。调配饮片时，每剂中药的重量误差应控制在±5%以内（D对）。中药饮片调配复核内容：中药饮片调配后，必须经复核后方可发出。核对调配好的药品是否与处方所开药味及剂数相符，有无错味、漏味、多味和掺杂异物，每剂药的剂量误差应小于±5%，必要时要复称。还需审查有无配伍禁忌（十八反、十九畏）、妊娠禁忌药物，毒麻药有无超量。毒性中药、贵细药品的调配是否得当。对于需特殊煎煮或处理的药味如先煎、后下、包煎、烊化、另煎、冲服等是否单包并注明用法。审查药品质量，保证无伪劣饮片，审查有无虫蛀、发霉变质，有无生炙不分或以生代炙，整药、籽药应捣未捣，调配处方有无乱代乱用等现象。